关于健康的概念，描述正确的是
A. 健康等于没有疾病和虚弱
B. 身体生理生化的各种功能正常即为健康
C. 精神处于完好状态即健康
D. 身体精神状况达到完好状态即健康
E. 身体、精神和社会适应能力完好状态就是健康

正确答案：E。身体、精神和社会适应能力完好状态就是健康

解析：本题考查健康的概念。健康是指一个人在身体、精神和社会适应各方面均处于完好状态（E对ABCD错）。